与ADP和ATP相互转变相关的过程是
A. 氧化与磷酸化的偶联
B. CO对电子传递的影响
C. 能量的贮存与利用
D. 2H⁺与1/2O₂的结合
E. 乳酸脱氢酶催化的反应

正确答案：C。能量的贮存与利用

解析：ATP是体内最重要的高能磷酸化合物，是细胞可直接利用的能量形式。与ADP和ATP相互转变相关的过程是能量的贮存与利用（C对），氧化与磷酸化的偶联（A错）驱动ADP生成ATP的过程是能量的贮存过程；ATP去磷酸化转变为ADP的过程即为能量的利用过程。2H⁺与1/2O₂的结合（D错）过程中释放的能量可驱动ADP磷酸化生成ATP，即氧化与磷酸化偶联生成ATP的过程（A错），但不包括ATP去磷酸化转变为ADP的能量利用过程。CO是呼吸链的抑制剂（B错），可与还原型Cyta₃结合，阻断氧化呼吸链的电子传递，阻止ADP磷酸化生成ATP。乳酸脱氢酶催化丙酮酸还原为乳酸的反应（E错），所需的氢原子由NADH+H⁺提供，此过程无ATP生成。